人造冠边缘与牙体组织间允许的微小间隙不超过
A. 30μm
B. 40μm
C. 50μm
D. 60μm
E. 70μm

正确答案：C。50μm

解析：人造冠边缘与牙体组织间无明显缝隙，允许的微小间隙不超过50μm。掌握“修复体试戴、磨光与粘固”知识点。